哪项不是对β内酰胺类抗生素产生耐药的原因
A. 细菌产生β内酰胺酶
B. PBPs与抗生素亲和力降低
C. PBPs数量减少
D. 菌细胞壁或外膜的通透性发生改变
E. 细菌缺少自溶酶

正确答案：C。PBPs数量减少